不属于牙周膜主纤维的是
A. 牙槽嵴组
B. 水平组
C. 斜行组
D. 牙骨膜组
E. 根间组

正确答案：D。牙骨膜组

解析：本题考查牙周膜纤维。不属于牙周膜主纤维的是牙骨膜组（D错，为本题的正确答案）。牙龈纤维包括龈牙组、牙槽龈组、环行组、牙骨膜组和越隔组。牙周膜纤维有牙槽嵴组（A对）、水平组（B对）、斜行组（C对）、根尖组和根间组（E对）。